患者，女，56岁。右下肢静脉迂曲扩张20年，伴下肢酸胀，水肿，活动或抬高患肢减轻，近2年右足靴区皮肤发红，时有瘙痒，逐渐加重，查体右下肢大腿内侧、小腿后可见迂曲扩张静脉团，足靴区色素沉着，皮肤变厚。该患者可能发生的最严重并发症是
A. 右小腿溃疡
B. 血栓性浅静脉炎
C. 右下肢坏死
D. 溃疡破裂出血
E. 右踝关节强直

正确答案：A。右小腿溃疡

解析：患者为中老年女性，右下肢静脉迂曲扩张20年，可见迂曲扩张静脉团，伴下肢酸胀、水肿，活动或抬高患肢减轻。后右足靴区出现皮肤营养性变化（发红、瘙痒，色素沉着，皮肤变厚）。根据患者的症状和体征可初步诊断为下肢慢性静脉功能不全。溃疡形成（A对）是下肢静脉功能不全最严重的并发症。血栓性浅静脉炎（B错）和曲张静脉破裂出血（D错）等均属于下肢静脉功能不全的常见并发症，及时纠正可以治愈。右下肢坏死（C错）、右踝关节强直（E错）不属于静脉系统疾病易发的并发症。